根据情志相胜法，可制约喜的情志是
A. 怒
B. 思
C. 悲
D. 恐
E. 惊

正确答案：D。恐

解析：人的情志活动，属五脏机能之一，而情志活动异常，又会损伤相应内脏。由于五脏之间存在相生相克的关系，故人的情志变化也有相互抑制作用。即一“行”的情志可以制约其“所胜”的情志。怒为肝志，属木；喜为心志，属火；思为脾志，属土；悲为肺志，属金；恐为肾志，属水。故怒伤肝，悲胜怒；喜伤心，恐胜喜（D对）；思伤脾，怒胜思；忧伤肺，喜胜忧；恐伤肾，思胜恐。